某男，28岁。鼻塞流脓涕，量多，呈黄绿色，有臭味，嗅觉差，头痛，目眩，耳鸣，口苦，心烦易怒，小便黄赤，舌红苔黄，脉弦数，治宜选用的中成药是
A. 鼻炎片
B. 藿胆片
C. 辛夷鼻炎丸
D. 珠黄散
E. 鼻窦炎口服液

正确答案：B。藿胆片

解析：本题考查的是鼻渊的辨证论治。鼻塞流脓涕，量多，呈黄绿色，有臭味，嗅觉差，头痛，目眩，耳鸣，口苦，心烦易怒，小便黄赤，舌红苔黄，脉弦数，治宜选用的中成药是藿胆片（B对）。鼻渊胆经郁热证：【症状】脓涕量多，色黄或黄绿，或有臭味，鼻塞重，嗅觉差，鼻黏膜红赤。伴头痛较剧，口苦，咽干，目眩，耳鸣，耳聋，寐少梦多，烦躁易怒，小便黄赤。舌质红，舌苔黄或腻，脉弦数。【中成药应用】常用中成药有鼻渊舒胶囊、藿胆片、胆香鼻炎片。中成药应用为鼻炎片（A错）、辛夷鼻炎丸（C错）、珠黄散（D错）或鼻窦炎口服液（E错）的病证，2022年考试指南未明确说明。